女，21岁。腹痛、呕吐3小时。进食生冷食物后出现上腹痛伴恶心、剧烈呕吐，呕吐物初为胃内容物，后为少量鲜血。引起呕血最可能的原因是
A. 急性糜烂出血性胃炎
B. 食管贲门黏膜撕裂综合征
C. 应激性溃疡
D. 十二指肠合并出血
E. 反流性食管炎合并出血

正确答案：B。食管贲门黏膜撕裂综合征

解析：成年女性患者，剧烈呕吐后呕血。综合患者的症状、体征，引起呕血最可能的原因是食管贲门黏膜撕裂综合征（B对）。急性糜烂出血性胃炎（A错）、应激性溃疡（C错）近期多有服用非甾体类抗炎药物史、酗酒史、大面积烧伤、颅脑手术、脑血管疾病和严重外伤。十二指肠溃疡合并出血（D错）主要表现为慢性起病，反复发作，饥饿痛与夜间痛。反流性食管炎合并出血（E错）主要表现为胸骨后烧灼感（烧心）、反流和胸痛。